国家对传染病菌种毒种的采集采取
A. 分类管理
B. 集中管理
C. 分区管理
D. 地域自制
E. 医院管理

正确答案：A。分类管理

解析：根据《传染病防治法》规定，国家建立传染病菌种、毒种库。对传染病菌种、毒种和传染病检测样本的采集、保藏、携带、运输和使用实行分类管理（A对），建立健全严格的管理制度。